男，50岁，10个月前经领导肯定后出现心情好，自我感觉良好，认为自己能力超群。话多，主动和陌生人打招呼，说话，每天睡2～3小时也没有困倦，经治疗后好转。近1个月女儿离婚后患者心情低落，高兴不起来，话少，自责惭愧，认为自己没有给女儿找到好对象。兴趣减退，活动明显减少。睡眠减退，夜间睡眠差，早醒。有自杀观念。隔空听到人说自己无能，没用。不能正常上班。该患者主要的治疗措施是
A. 抗焦虑药
B. 抗抑郁药
C. 镇静催眠药
D. 心境稳定剂
E. 抗精神药

正确答案：D。心境稳定剂

解析：患者10个月前经领导肯定后出现心情好，自我感觉良好，认为自己能力超群。话多，主动和陌生人打招呼，说话，每天睡2～3小时也没有困倦（躁狂表现），经治疗后好转，近1个月女儿离婚后心情低落，高兴不起来（心境低落），话少，自责惭愧（自责自罪）。睡眠减退，夜间睡眠差，早醒。有自杀观念（自杀行为）。隔空听到人说自己无能，没用（幻听），综合患者临床表现，诊断为双相障碍抑郁发作。治疗应遵守：综合治疗原则、个体化治疗原则、心境稳定剂为基础治疗原则及联合用药治疗原则（D对）：包括多种心境稳定剂联合；心境稳定剂与苯二氮卓类药物（镇静催眠、抗焦虑药：药物范围广泛，但都能抑制中枢神经系统的活动）联用（AC错）；与抗精神病药物联用（E错）；双相障碍抑郁发作联合用药时，慎用抗抑郁药物（B错）。常见的心境稳定剂为：锂盐、卡马西平和丙戊酸盐。